女30岁，近年来经常上腹灼痛，反酸，疼痛多出现在上午10点及午后4点，有时夜间痛醒，进食后缓解。X线钡餐诊断为十二指肠溃疡，应选用的药物是
A. 阿托品
B. 胃舒平
C. 胃得乐
D. 雷尼替丁
E. 乐得胃

正确答案：D。雷尼替丁